从富含挥发油的新鲜植物药材中提取挥发油的常用方法是
A. 压榨法
B. 溶剂提取法
C. 水蒸气蒸馏法
D. C02超临界流体提取法
E. 盐析法

正确答案：A。压榨法